根据《关于建立国家基本药物制度的实施意见》，政府举办的基层医疗卫生机构配备使用的基本药物实行
A. 全国零售指导价销售
B. 零差率销售
C. 在进价的基础上加价5%销售
D. 在进价的基础上加价10%销售
E. 在进价的基础上加价15%销售

正确答案：B。零差率销售

解析：本题考查基本药物使用和销售的规定。《关于建立国家基本药物制度的实施意见》十二条 实行基本药物制度的县（市、区），政府举办的基层医疗卫生机构配备使用的基本药物实行零差率销售（B对）。各地要按国家规定落实相关政府补助政策。